男，35岁，从高处跳下时，双下肢顿时感到无力在急诊室骨科首先做的影像学检查是
A. MRI
B. CT
C. 核素骨扫描
D. X线
E. B型超声

正确答案：D。X线

解析：患者高空跳下后，双下肢顿时感到无力（提示可能有脊髓损伤），结合患者病史和临床表现，该患者最可能的诊断为脊柱骨折合并脊髓损伤。骨折首选的检查是X线平片（D对），对疑有脊髓、神经损伤或椎间盘损伤时应作脊柱相应部位的核磁共振检查（MRI）（A错），但并非首先要做的检查。CT（B错）常用于X线无法显示的骨折，因价格昂贵，一般不作为首选检查。核素骨扫描（C错）主要用于诊断恶性肿瘤骨转移骨。B型超声（E错）对骨折的诊断意义不大。